既是抑菌剂，又是表面活性剂的是
A. 苯扎溴铵
B. 液状石蜡
C. 苯甲酸
D. 聚乙二醇
E. 羟苯乙酯

正确答案：A。苯扎溴铵

解析：本题考查液体制剂常用的附加剂。苯扎溴铵（A对）既是抑菌剂，又是阳离子表面活性剂；液体石蜡（B错）可作为药物乳化剂；苯甲酸（C错）可作为抑菌剂和助溶剂；聚乙二醇（D错）有良好的水溶性，与许多有机物组份有良好的相溶性，可作为潜溶剂；羟苯乙酯（E错）为药物防腐剂。